皮肤病急性期有渗出液，腐烂时，宜首选
A. 软膏剂
B. 溶液剂
C. 洗剂
D. 膜剂
E. 糖浆剂

正确答案：B。溶液剂

解析：本题考查药物的剂型。皮肤病急性期有渗出液，腐烂时，宜首选溶液剂（B对）。同一药物，剂型不同，适用于疾病的发生发展阶段不同。如皮肤病，一般急性期局部有红肿、水疱、糜烂时，多选用溶液剂湿敷，可起到消炎作用；慢性期皮损增厚，呈苔藓样变时，多用软膏剂（A错）和乳膏剂，其穿透力强，作用持久，且有润滑及护肤作用。洗剂（C错）适用于无腐烂及渗出型急性皮肤病。膜剂（D错）适用于口服、舌下、眼结膜囊、口腔、阴道、体内植入、皮肤和黏膜创伤、烧伤或炎症表面等各种途径和方法给药，以发挥局部或全身作用。糖浆剂（E错）主要供口服使用，治疗咳嗽等症状。